近年我国卫生费用占国民生产总值的比例大约为
A. 0.02
B. 0.04
C. 0.06
D. 0.03
E. 0.05

正确答案：B。0.04

解析：本题考查近年我国卫生费用占国民生产总值的比例。近年我国卫生费用占国民生产总值的比例大约为0.04（B对ACDE错）。